在用药期间应定期检查血常规
A. 卡马西平
B. 乙胺丁醇
C. 褪黑素
D. 环孢素
E. 氟桂利嗪

正确答案：D。环孢素